急性乳腺炎的重要病因是
A. 有乳腺增生
B. 哺乳次数太多
C. 乳汁淤积和细菌入侵
D. 乳腺发育偏小
E. 抵抗力差合并病毒感染

正确答案：C。乳汁淤积和细菌入侵